APC不包括
A. B细胞
B. MΦ
C. 树突状细胞
D. 内皮细胞
E. 粒细胞

正确答案：E。粒细胞